采取的诊疗措施使患者的痛苦最小、耗费最少、效果最好、安全度最高属于
A. 最优化原则
B. 患者至上原则
C. 知情同意原则
D. 保密守信原则
E. 酌情隐瞒原则

正确答案：A。最优化原则

解析：最优化原则是指在选择诊疗方案时以最小的代价获得最大效果的决策。具体地说，医务人员在选择诊疗方案时，在当时的医学科学发展水平和客观条件下，采取的诊疗措施使患者的痛苦最小、耗费最少、效果最好、安全度最高。掌握“临床诊疗和临床诊断的伦理”知识点。